治疗心室停顿的首选药物是
A. 胺碘酮
B. 利多卡因
C. 多巴酚丁胺
D. 肌苷
E. 肾上腺素

正确答案：E。肾上腺素

解析：肾上腺素（E对）心室内注射可用于溺水、麻醉和手术过程中的意外、药物中毒、传染病和心脏传阻滞等所致的心脏骤停。对电击所致的心脏骤停用肾上腺素配合心脏除颤器或利多卡因等除颤（九版药理学P81）。胺碘酮（P206）（A错）适用于各种室上性与室性快速性心律失常，包括心房扑动与颤动、预激综合征；肥厚型心肌病、心肌梗死后室性心律失常、复苏后预防室性心律失常复发。利多卡因（九版药理学P196）（B错）主要治疗室性心律失常，如心脏手术、心导管术、急性心肌梗死或强心苷中毒所致的室性心动过速或心室纤颤。多巴酚丁胺（九版病理学P238）（C错）是多巴胺的衍生物，直接作用于心脏，加快心率的效应比较小，能降低心室充盈压，只能短期静脉应用，在慢性心衰加重时起到帮助患者渡过难关的作用，不用于心室停顿。肌苷（D错）为冠状动脉粥样硬化性心脏病的辅助用药。